以下关于颞下颌关节紊乱病的叙述，哪项是错误的
A. 本病有自限性
B. 治疗不及时会发生关节强直
C. 并非指单一疾病，而是一组疾病的总称
D. 三个主要临床症状是下颌运动异常疼痛及关节弹响和杂音
E. 是多因素所致疾病，关节内微小创伤与精神心理因素是本病的两个主要致病因素

正确答案：B。治疗不及时会发生关节强直

解析：颞下颌关节紊乱病好发于青壮年，以20～30岁患病率、就诊率最高。颞下颌关节紊乱病并非指单一疾病，它是一类病因尚未完全清楚而又有相同或相似临床症状的一组疾病的总称。一般都有颞下颌关节区及（或）咀嚼肌肌痛、下颌运动异常和伴有功能障碍以及关节弹响、破碎音及杂音三类症状。颞下颌关节紊乱病多数为功能紊乱性质，也可累及关节结构紊乱甚至器质性破坏。颞下颌关节紊乱病虽然病期较长，并经常反复发作；但是本病有自限性，一般不发生关节强直，预后良好。掌握“颞下颌关节紊乱”知识点。